下列哪项不符合G蛋白的特点
A. 又称鸟苷三磷酸结合蛋白
B. 由α、β、γ三种亚基组成
C. α亚基能与GTP、GDP结合
D. α亚基具有GTP酶活性
E. βγ结合松弛

正确答案：E。βγ结合松弛